主持水液代谢的脏是
A. 心
B. 肺
C. 脾
D. 肝
E. 肾

正确答案：E。肾

解析：津液代谢过程中，各个脏腑形体官窍代谢后产生的浊液，以及胃肠道中的部分津液，通过三焦水道下输于膀胱，在肾气的蒸化作用下，其清者经脾达肺，重新参与代谢，浊者留而为尿；并且肾气对参与津液代谢的脏腑有促进作用。（E对）。肺（B错）主行水，肺气的宣发肃降推动和调节全身津液的输布和排泄。脾（C错）主运化，可以运化水液，可将水饮化为水精，并将其吸收，转输到全身脏腑。肝（D错）主疏泄，可以调畅气机，气行则津液布散。